为配制有效氯浓度为500mg/L的消毒剂10L，需要次氯酸钠溶液（有效氯浓度为6.0%）和纯化水的量分别是
A. 83ml和9917ml
B. 830ml和9170ml
C. 120ml和9880ml
D. 150ml和9850ml
E. 500ml和9500ml

正确答案：A。83ml和9917ml

解析：本题考查溶液配制的计算。所需氯的量=500mg/L×10L=5000mg=5g。有效氯浓度为6.0%的次氯酸溶液指100ml含氯6g，则需要次氯酸钠的量=100ml×5/6=83ml（A对）。